女，突发膀胱刺激症状伴血尿，无发热及腰痛，应先考虑
A. 急性膀胱炎
B. 急性肾盂肾炎
C. 泌尿系结核
D. 膀胱结石
E. 膀胱肿瘤

正确答案：A。急性膀胱炎

解析：女性患者，突发膀胱刺激症状伴血尿（提示可能有泌尿系感染），无发热、腰痛（可排除上尿路感染），故应先考虑急性膀胱炎（A对）。急性肾盂肾炎（B错）主要表现为发热、腰痛和膀胱刺激症状。泌尿系结核（C错）典型表现为膀胱刺激症状伴终末血尿，可出现低热、盗汗、消瘦等结核中毒症状。膀胱结石（D错）典型症状为排尿突然中断，疼痛放射至远端尿道及阴茎头部，伴排尿困难和膀胱刺激征。膀胱肿瘤（E错）典型表现为间歇性、全程无痛性血尿，膀胱刺激征多为晚期表现。